下列哪种情况可触觉语颤增强
A. 阻塞性肺不张
B. 压迫性肺不张
C. 胸膜高度增厚
D. 胸腔积液
E. 皮下水肿

正确答案：B。压迫性肺不张

解析：触觉语颤为被检查者发出语音时，声波起源于喉部，沿气管、支气管及肺泡，传到胸壁所引起共鸣的震动，语颤的强弱主要取决于气管、支气管是否通畅，胸壁传导是否良好，一般来说发音强、音调低、胸壁薄及支气管至胸壁距离近者语颤增强，压迫性肺不张（B对）是肺部受到了挤压而不能舒张，由于有外压因素，语颤可通过压迫物传导，使触觉语颤增强。触觉语颤增强主要见于：①肺泡内有炎症浸润，因肺组织实变使语颤传导良好，如大叶性肺炎实变期、大片肺梗死等；②接近胸膜的肺内巨大空腔，声波在空洞内产生共鸣，尤其是当空洞周围有炎性浸润并与胸壁黏连时，有利于声波传导，使语颤增强，如空洞型肺结核、肺脓肿等。语颤减弱或消失主要见于：①肺泡内含气量过多，如慢性阻塞性肺疾病；②支气管阻塞，如阻塞性肺不张（A错）；③大量胸腔积液（D错）或气胸；④胸膜显著增厚黏连（C错）；⑤胸壁皮下气肿。胸壁皮下水肿（E错）由于液体使声波传导减弱，语颤减弱。